专项规划的环境影响报告书应当包括
A. 建设项目周围环境现状
B. 建设项目环境保护措施及其技术、经济论证
C. 建设项目对环境影响的经济损益分析
D. 以上全是
E. 以上都不是

正确答案：E。以上都不是